应激时糖皮质激素不具有下列哪一种作用？
A. 促进蛋白质分解
B. 促进脂肪分解
C. 稳定溶酶体膜
D. 降低血糖
E. 维持心血管对儿茶酚胺的敏感性

正确答案：D。降低血糖

解析：应激时糖皮质激素（GC）具有促进蛋白质分解（A对）、促进脂肪分解（B对）、稳定溶酶体膜（C对）、维持心血管对儿茶酚胺的敏感性（E对）和升高血糖（D错，为本题正确答案）。